关于结核病临床症状正确的是
A. 高热
B. 呼吸困难
C. 食欲旺盛
D. 乏力
E. 向心性肥胖

正确答案：D。乏力

解析：肺结核症状：全身结核中毒症状，如低热、盗汗、乏力、食欲缺乏和体重减轻等，育龄女性可有月经不调或闭经。主要呼吸道症状为咳嗽、咳痰和咯血，以干咳为主，多为少量咯血，少数为大咯血。掌握“肺结核”知识点。